损伤后导致左眼直接对光反射和右眼间接对光反射消失
A. 右侧动眼神经
B. 右侧视神经
C. 左侧视神经
D. 左侧动眼神经
E. 右侧动眼神经和视神经

正确答案：C。左侧视神经

解析：瞳孔对光反射在临床上有重要意义，反射消失，可能预示病危。但视神经或动眼神经受损，也能引起瞳孔对光反射的变化。一侧视神经（C对）受损时，信息传入中断，光照患侧眼的瞳孔，两侧瞳孔均不反应；但光照健侧眼的瞳孔，则两眼对光反射均存在（此即患侧眼的瞳孔直接对光反射消失，间接对光反射存在）。